以下关于槽生牙的说法错误的是
A. 槽生牙有较完善的牙根
B. 槽生牙位于牙槽窝内
C. 槽生牙有血管神经末梢从根尖孔入髓腔
D. 槽生牙的动物为哺乳类动物
E. 槽生牙可以在一生中不停地被替换

正确答案：E。槽生牙可以在一生中不停地被替换

解析：槽生牙：此类牙齿有较完善的位于牙槽窝内的牙根，并有血管和神经末梢从根尖孔进入髓腔。哺乳动物包括人类的牙齿均为槽生牙。掌握“牙的演化”知识点。